接收食物中毒患者进行治疗的单位，除采取抢救措施外，应当根据国家有关规定，及时向哪个部门报告
A. 卫生行政部门
B. 卫生防疫机构
C. 所在地卫生行政部门
D. 所在地疾病控制机构
E. 所在地人民政府主管部门

正确答案：C。所在地卫生行政部门